对鱼类的营养价值描述错误的是
A. 蛋白质含量一般为15%～25%
B. 含脂肪很少，一般为1%～10%
C. 脂肪多由不饱和脂肪酸组成（占80%），熔点低
D. 含铁、锌、硒较为丰富
E. 是维生素A和维生素C的重要来源

正确答案：E。是维生素A和维生素C的重要来源

解析：本题考查鱼类的营养价值。鱼类肝脏是维生素A和维生素D的重要来源，也是维生素B₂的良好来源，维生素E维生素B₁和烟酸的含量也较高，但几乎不含维生素C（E错，为本题正确答案）。鱼类中蛋白质含量因鱼的种类、年龄、肥瘦程度及捕获季节等不同而有区别，一般为15%～25%（A对）。鱼类脂肪含量低，一般为1%～10%（B对），鱼类脂肪多由不饱和脂肪酸组成（占80%），熔点低（C对）。鱼类矿物质含量为1%～2%，含铁、锌、硒较为丰富（D对）。